下列哪项不属于硅酸盐
A. 石棉
B. 滑石
C. 云母
D. 水泥
E. 花岗岩

正确答案：E。花岗岩